关于我国公共卫生监测的内容，不正确的是
A. 法定报告的传染病
B. 突发公共卫生事件
C. 群体性事件
D. 出生缺陷
E. 医院感染

正确答案：C。群体性事件

解析：本题考查公共卫生监测的内容。公共卫生监测的种类和内容主要包括：1.疾病监测：①传染病监测（A对）；②慢性非传染病监测：主要包括恶性肿瘤、心脑血管病、糖尿病、精神性疾病、职业病、出生缺陷（D对）等；③医院感染监测（E对）；④死因监测。2.症状监测；3.行为及行为危险因素监测；4.其他公共卫生监测（B对）：包括环境监测、食品卫生监测、营养监测、学校卫生监测、药品不良反应监测、计划生育药具使用及不良反应监测等。群体性事件（C错，为本题正确答案）不属于我国公共卫生监测的内容。